下列有关法律效力层次的说法，正确的有
A. 在同一位阶的法之间，特别规定优于一般规定
B. 下位法违反上位法规定的，由有关机关依法予以改变或者撤销
C. 上位法的效力高于下位法
D. 在同一位阶的法之间，旧的规定优于新的规定

正确答案：A、B、C。在同一位阶的法之间，特别规定优于一般规定；下位法违反上位法规定的，由有关机关依法予以改变或者撤销；上位法的效力高于下位法

解析：本题考查的是法的效力冲突及其解决。下列有关法律效力层次的说法，正确的有在同一位阶的法之间，特别规定优于一般规定（A对）；下位法违反上位法规定的，由有关机关依法予以改变或者撤销（B对）；上位法的效力高于下位法（C对）。法的效力冲突及其解决：由于正式的法的渊源本身是有层次或等级划分的，因而其效力当然具有层次或等级性。法律效力的层次是指规范性法律文件之间的效力等级关系。正式的法的渊源的效力和冲突解决原则包括不同位阶的法的渊源之间的冲突原则、同一位阶的法的渊源之间的冲突原则、位阶出现交叉时的法的渊源之间的冲突原则。（1）不同位阶法的渊源冲突的解决原则：上位法的效力高于下位法，宪法至上、法律高于法规、法规高于规章、行政法规高于地方性法规。按《立法法》的规定，下位法违反上位法规定的，由有关机关依照该法规定的权限予以改变或者撤销。（2）同一位阶法的渊源冲突的解决原则：特别规定优于一般规定，新的规定优于旧的规定（D错）。《立法法》规定：同一机关制定的法律、行政法规、地方性法规、自治条例和单行条例、规章，特别规定与一般规定不一致的，适用特别规定；新的规定与旧的规定不一致的，适用新的规定。法律之间对同一事项的新的一般规定与旧的特别规定不一致，不能确定如何适用时，由全国人民代表大会常务委员会裁决。行政法规之间对同一事项的新的一般规定与旧的特别规定不一致，不能确定如何适用时，由国务院裁决。（3）位阶出现交叉时法的渊源冲突的解决原则：自治条例和单行条例依法对法律、行政法规、地方性法规作变通规定的，在本自治地方适用自治条例和单行条例的规定。经济特区法规根据授权对法律、行政法规、地方性法规作变通规定的，在本经济特区适用经济特区法规的规定。地方性法规与部门规章之间对同一事项的规定不一致时，由国务院提出意见，国务院认为应当适用地方性法规的，应当决定适用地方性法规；认为应当适用部门规章的，应当提请全国人民代表大会常务委员会裁决。部门规章之间、部门规章与地方政府规章之间对同一事项的规定不一致时，由国务院裁决。根据授权制定的法规与法律规定不一致时，由全国人民代表大会常务委员会裁决。同一机关制定的新的一般规定与旧的特别规定不一致时，由制定机关裁决。